治疗糖尿病的药物有
A. 阿卡波糖
B. 甲巯咪唑
C. 氨鲁米特
D. 瑞格列奈
E. 吡格列酮

正确答案：A、D、E。阿卡波糖；瑞格列奈；吡格列酮

解析：本题考查治疗糖尿病的药物。治疗糖尿病的药物有：1.胰岛素；2.口服降糖药：①磺酰脲类促胰岛素分泌药：格列本脲、格列吡嗪、格列齐特等。②非磺酰脲类促胰岛素分泌药：瑞格列奈（D对）、那格列奈等；③双胍类：二甲双胍；④α-葡萄糖苷酶抑制剂：阿卡波糖（A对）；⑤噻唑烷二酮类胰岛素增敏剂：吡格列酮（E对）。甲巯咪唑（B错）为抗甲状腺药物；氨鲁米特（C错）为皮质激素抑制药。